保泰松在体内代谢成羟布宗，发生的代谢反应是
A. 芳环羟基化
B. 硝基还原
C. 烯烃氧化
D. N-脱烷基化
E. 乙酰化

正确答案：A。芳环羟基化

解析：本题考查药物化学结构与药物代谢。保泰松在体内代谢成羟布宗，发生的代谢反应是芳环羟基化（A对）反应。含芳环的药物主要发生氧化代谢，芳环经CYP450酶系催化氧化成环氧化合物，后又重排生成酚，或者发生水解反应生成二羟基化合物。